采用抗体检测蛋白质的分子量的方法
A. 免疫PCR
B. 免疫沉淀法
C. 免疫印迹试验(Westernblotting)
D. 斑点杂交
E. Southemblotting

正确答案：C。免疫印迹试验(Westernblotting)

解析：免疫印迹，又称Westernblotting，是一种采用抗体检测蛋白质的分子量和抗原特异性的方法。掌握“免疫学检测技术”知识点。